关于解热镇痛抗炎药的分类、药理作用与临床评价的说法，正确的有
A. 非甾体抗炎药具有中等程度的镇痛作用，其镇痛作用部位主要在外周
B. 非甾体抗炎药对创伤引起的剧烈疼痛和内脏平滑肌绞痛无效
C. 解热镇痛抗炎药又名非甾体抗炎药，包括糖皮质激素类药物
D. 非甾体抗炎药不但能降低发热者的体温，也能降低正常人的体温
E. 非甾体抗炎药中，抗炎作用最强的是对乙酰氨基酚

正确答案：A、B。非甾体抗炎药具有中等程度的镇痛作用，其镇痛作用部位主要在外周；非甾体抗炎药对创伤引起的剧烈疼痛和内脏平滑肌绞痛无效

解析：本题考查解热镇痛抗炎药的分类、药理作用与临床评价。非甾体抗炎药具有中等程度的镇痛作用，其镇痛作用部位主要在外周（A对）；对创伤引起的剧烈疼痛和内脏平滑肌绞痛无效（B对）；能降低发热者的体温，不能降低正常人的体温（D错）；非甾体抗炎药不包括糖皮质激素类药物（C错）；对乙酰氨基酚几乎没有抗炎作用（E错）。